提示上运动神经元损害最有意义的体征是
A. 瘫痪肌肉不萎缩
B. 病理征阳性
C. 腱反射减弱
D. 浅反射消失
E. 肌张力正常

正确答案：B。病理征阳性

解析：上运动神经元损害特点为瘫痪分布于整个肢体，肌张力增高（E错），浅反射消失，腱反射增强（C错），病理反射阳性，无肌萎缩或轻度废用性萎缩，肌电图正常，多无皮肤营养障碍。综上，ABD选项均为上运动神经元损害时的表现，但是，浅反射消失（D错）也可见于下运动神经元损害，所以不具有特异性；长期瘫痪时，由于缺少运动，肌肉可出现废用性萎缩（A错）；而临床常采用检查巴氏征、克氏征等病理征是否阳性来判断是否存在上神经元损害，故病理征阳性（B对）最具意义。